能形成半月板的结构是
A. 浆液腺泡
B. 黏液腺泡
C. 混合性腺泡
D. 闰管
E. 分泌管

正确答案：C。混合性腺泡

解析：混合性腺泡：由黏液细胞和浆液细胞组成。前者组成腺泡之大部分，紧接闰管；后者呈新月状覆盖于腺泡的盲端表面，又名半月板。浆液细胞的分泌物有细胞间小管通入腺泡腔内。掌握“唾液腺组织结构”知识点。